根管口是指
A. 髓室和根管的交界处
B. 根管末端的开口处
C. 髓腔的开口处
D. 髓室的开口处
E. 根管的开口处

正确答案：A。髓室和根管的交界处

解析：本题考查根管口。根管口是指髓室和根管的交界处（A对）。根管口是指髓室和根管的交界处；根管末端的开口处称为根尖孔（B错）。